环境中的化学物，属于二次污染物是
A. SO₂
B. NO₂
C. N₂O
D. CO
E. CO₂

正确答案：A。SO₂

解析：二次污染物为从污染源直接排出的一次污染物，在大气中受到化学作用或光化学作用，本身产生了化学变化，转变成毒性比一次污染物更大的化学物质，SO₂在这种情况下可视为二次污染物（A对）。NO₂（B错）、N₂O（C错）、CO（D错）、CO₂不属于二次污染物（E错）。